成人股骨头最主要的血供来源是
A. 干骺端上侧动脉
B. 股骨干滋养动脉升支
C. 骺外侧动脉
D. 圆韧带内的小凹动脉
E. 干骺端下侧动脉

正确答案：C。骺外侧动脉

解析：成人股骨头最主要的血供来源是骺外侧动脉（C对）。成人股骨头的血液供应有多种来源：①股骨头圆韧带内的小凹动脉（D错），提供股骨头凹部的血液循环；②股骨干滋养动脉升支（B错），沿股骨颈进入股骨头；③旋股内、外侧动脉的分支，是股骨头、颈的重要营养动脉。旋股内侧动脉发自股深动脉，在股骨颈基底部关节囊滑膜反折处，分为骺外侧动脉、干骺端上侧动脉（A错）和干骺端下侧动脉（E错）进入股骨头。